关于肝的位置说法错误的是
A. 大部分位于右季肋区和腹上区
B. 前面大部分为肋掩盖
C. 小部分于剑突下直接与腹前壁相接触
D. 上界在右锁骨中线与第6肋相交
E. 平静呼吸时，肝可上下移动的范围约为2-3cm

正确答案：D。上界在右锁骨中线与第6肋相交

解析：肝大部分位于右季肋区和腹上区(A对)，前面大部分被肋掩盖(B对)，一小部分在剑突下露出直接与腹前壁接触(C对)，上界在右锁骨中线与第5肋相交(D错，为本题正确答案)，平静呼吸时，肝可上下移动约2-3cm(E对)。